新的疫苗或预防药物在研制期间必须做
A. 通过毒理学鉴定证明其对人体无害
B. 通过临床试验考核其效果
C. 通过动物试验证实其效果
D. 证明其无严重副作用
E. 经实验室检验无有害的附加剂

正确答案：B。通过临床试验考核其效果

解析：本题考查临床试验的作用。临床试验可用于研究新的疫苗或预防药物的研究工作。通过临床试验考核疫苗或药物的效果（B对ACDE错）和安全性。